男，7岁。便血10天。大便时见粪便表面附有鲜血，有时在大便后有鲜血滴出，无腹痛，大便次数正常，粪便形状正常。首先考虑的诊断是
A. 内痔
B. 直肠脱垂
C. 直肠息肉
D. 肛窦炎
E. 肛裂

正确答案：C。直肠息肉

解析：儿童鲜血便以直肠息肉多见，首先考虑的诊断是直肠息肉（C对）。儿童痔极少见，成人鲜血便以内痔（A错）出血多见。直肠脱垂（B错）可见直肠黏膜自肛门脱出。肛窦炎（D错）表现为红肿热痛。肛裂（E错）排便时疼痛剧烈。